患者干咳少痰，痰中带血，潮热盗汗，胸闷隐痛，身体逐渐消痩，口燥咽干，舌红少苔，脉细数。其诊断是
A. 肺痨
B. 肺痿
C. 咳血
D. 虚劳
E. 肺胀

正确答案：A。肺痨

解析：题中患者符合肺痨咳嗽、咳血、潮热、盗汗及身体消瘦的典型特征，故诊断为肺痨（A对）。肺痿以咳吐浊唾涎沫为主症，题中患者无此症状（B错）。咳血阴虚肺热在虽有潮热盗汗，但无身体消瘦的症状（C错）。虚劳为两脏或多脏的气血阴阳亏虚，题中仅为肺脏（D错）。肺胀以喘息气促，咳嗽，咯痰，胸部膨满，憋闷如塞，或唇甲紫绀，心悸浮肿为主要表现（E错）。